剥脱性龈病损的病理变化不包括
A. 上皮萎缩
B. 上皮增生
C. 上皮内疱
D. 胶样小体
E. 基底细胞变性

正确答案：B。上皮增生

解析：本题考查牙龈疾病。上皮增生（B错，为本题正确答案）不符合剥脱性龈病损的病理变化。镜下剥脱性龈病损可分为疱型与苔藓型。疱型是上皮与结缔组织间形成基底下疱，结缔组织内有明显的炎症，病变同良性黏膜类天疱疮。如果在上皮内形成上皮内疱（C对），则病变同天疱疮。苔藓型者，上皮萎缩（A对），基底细胞水肿（E对），基底层附近常见胶样小体（D对），病变符合于疱型或萎缩型扁平苔藓。